“诸热之而寒者，取之阳”，是指
A. 阴病治阳
B. 阴中求阳
C. 因寒用热
D. 寒者热之
E. 用热远热

正确答案：A。阴病治阳

解析：“诸热之而寒者，取之阳”是指用温热的药物治疗寒症，寒症不除，反而更甚，那么就应该用补阳的方法，因为病的本质是虚寒而不是实寒证。阳虚不能制阴，常表现为阳虚阴盛的虚寒证，则补阳以制阴，即阴病治阳（A对）。阴中求阳是指补阳时适当佐以补阴药（B错）。寒者热之是指寒性病证出现寒象，用温热方药来治疗。即以热药治寒证（D错）。用热远热是指用温热方药及食物时，当避其气候之温热，属于因时制宜的原则（E错）。